化痰止咳平喘药的适应范围主要有
A. 咳嗽痰多
B. 癫痫惊厥
C. 瘰疬瘿瘤
D. 痰饮喘息
E. 阴疽流注

正确答案：A、B、C、D、E。咳嗽痰多；癫痫惊厥；瘰疬瘿瘤；痰饮喘息；阴疽流注

解析：本题考查的是化痰止咳平喘药的适用范围。化痰止咳平喘药的适应范围主要有咳嗽痰多（A对）、癫痫惊厥（B对）、瘰疬瘿瘤（C对）、痰饮喘息（D对）与阴疽流注（E对）。凡以祛痰或消痰为主要功效的药物，称为化痰药；能减轻或制止咳嗽和喘息的药物，称为止咳平喘药。合之则称为化痰止咳平喘药。本类药或辛或苦，或温或寒，多入肺经，辛开宣散，苦燥降泄，温化寒清，主能宣降肺气、化痰止咳、降气平喘，部分药物分别兼有散寒、清热、散结、润肺等作用。本类药主要适用于外感或内伤所致的咳嗽、气喘、痰多，或痰饮喘息，或因痰所致的瘰疬瘿瘤、阴疽流注、癫痫惊厥等。